阳偏衰所形成的证候性质是
A. 实热
B. 实寒
C. 虚热
D. 虚寒
E. 真热假寒

正确答案：D。虚寒

解析：阳偏衰是阳气的衰少，会出现虚寒证（D对）。阳偏胜导致实热（A错），阴偏胜导致实寒（B错），阴偏衰导致虚热（C错），真热假寒又称阳盛格阴，是阳气偏盛至极，深伏于里，热盛于内，排斥阴气于外的一种病理变化（E错）。